患者自汗，多尿，滑精，是气的何种作用失常
A. 推动
B. 温煦
C. 防御
D. 固摄
E. 气化

正确答案：D。固摄

解析：气的固摄作用是对体内血、津液、精等液态物质的固护、统摄和控制作用，防止其无故流失，保证发挥正常的生理功能。若气的固摄作用减弱，可能导致体内液态物质的大量丢失。患者自汗，多尿，滑精都是气的固摄功能失常（D对）。气的推动（A错）作用主要体现在激发和促进人体的生长发育与生殖机能；激发和促进各脏腑经络的生理机能；激发和促进精血津液的生长和运行输布；激发和兴奋精神活动。气的温煦（B错）作用是温煦机体，维持相对恒定的体温；温煦各脏腑、经络、形体、官窍，助其进行正常的生理活动；温煦精血津液，助其正常施泄、循行、输布。气的防御（C错）作用是护卫肌表，防御外邪入侵，同时可以祛除侵入人体内的病邪。气化（E错）指的是气的运动产生的各种变化。